可直接抑制钠离子选择性通道的药物
A. 呋喃苯胺酸
B. 乙酰唑胺
C. 安体舒通
D. 氨苯蝶啶
E. 甘露醇

正确答案：D。氨苯蝶啶

解析：本题考查利尿药的作用机制。可直接抑制钠离子选择性通道的药物是氨苯蝶啶（D对）。氨苯蝶啶为肾小管上皮细胞Na⁺通道阻滞剂，主要作用于远曲小管末端和集合管，通过阻滞管腔膜Na⁺通道而减少Na⁺的重吸收，同时由于Na⁺的重吸收减少使管腔的负电位降低，导致驱动K⁺分泌的动力减少，抑制了K⁺分泌，因而产生排Na⁺、利尿、保K⁺的作用。呋喃苯胺酸（A错）即呋塞米，是高效利尿药。乙酰唑胺（B错）为碳酸酐酶抑制剂。安体舒通（C错）即螺内酯，为醛固酮受体拮抗剂。甘露醇（E错）为渗透性利尿药。